引起肾前性急性肾衰竭的病理因素是
A. 汞中毒
B. 双侧输尿管结石
C. 肾小球肾炎
D. 休克早期
E. 尿路梗阻

正确答案：D。休克早期

解析：肾前性急性肾衰竭常见于各型休克早期（D对）。